男孩，1岁。发热伴咳嗽3天，食欲差。偶有呕吐，嗜睡，抽搐2次，双肺可闻及中细湿啰音，心率110次/分，呼吸56次/分，肝肋下1cm，白细胞4×10⁹/L。目前的主要诊断为
A. 急性支气管肺炎
B. 急性左心衰
C. 支气管哮喘
D. 过敏性肺炎
E. 支气管异物

正确答案：A。急性支气管肺炎

解析：患儿发热、咳嗽、双肺闻及中细湿啰音、呼吸频率增快，应诊断为急性支气管肺炎（A对）。患儿嗜睡、抽搐应考虑为重症支气管肺炎。急性左心衰常表现为呼吸困难、心率增快（B错）。支气管哮喘常表现为阵发性咳嗽和喘息（C错）。过敏性肺炎常于接触过敏原数小时发病，表现为发热、干咳、呼吸困难、胸痛、紫绀等（D错）。支气管异物常有突然剧烈呛咳史，以吸气性呼吸困难为主要表现（E错）。